儿童的第一次口腔检查应在第一颗乳牙萌出
A. 6个月内
B. 8个月内
C. 10个月内
D. 12个月内
E. 14个月内

正确答案：A。6个月内

解析：首次口腔检查儿童的第一次口腔检查应在第一颗乳牙萌出后6个月内，请医师帮助判断儿童乳牙萌出情况并评估其患龋病的风险，提供有针对性的口腔卫生指导并建立婴儿的口腔健康档案。掌握“婴幼儿的口腔保健”知识点。